在人群健康效应谱中，准病态（即亚临床状态）的变化是
A. 生理代偿的变化
B. 体内负荷增加的变化
C. 正常调节的变化
D. 出现严重中毒
E. 生理异常的变化

正确答案：E。生理异常的变化

解析：本题考查在人群健康效应谱中，准病态（即亚临床状态）的变化。准病态（亚临床状态）是指机体处于病理性的代偿和调节状态，无明显临床症状。在人群健康效应谱中，准病态（亚临床状态）的变化是生理异常的变化（E对ABCD错）。